利多卡因在体内的主要代谢物是
A. N-脱乙基物
B. 酰胺水解，生成2，6-二甲基苯胺
C. 苯核上的羟基化产物
D. 乙基氧化成醇的产物
E. N-氧化物

正确答案：A。N-脱乙基物